男，53岁，下火车之后感觉有一场针对自己的大阴谋正在实施，原因是看到人都在往出站口跑，该患者是什么精神症状
A. 原发性妄想
B. 继发性妄想
C. 谵妄
D. 失神发作
E. 错觉

正确答案：A。原发性妄想

解析：男，53岁，下火车之后感觉有一场针对自己的大阴谋正在实施，原因是看到人都在往出站口跑，结合患者的表现，提示为原发性妄想（A对）。继发性妄想：是发生在其他病理心理基础上的妄想，或与某种经历、情境等有关的妄想（B错）。谵妄被定义为“以注意力障碍（指向、集中、维待以及注意的转移）和意识障碍（对环境定性能力的减弱）为特征，在短时间内产生并在一天内症状呈现波动变化的一组综合征，通常伴随着其他认知损伤，如记忆障碍、定向力障碍或言语紊乱、视觉空间、知觉感知障碍以及睡眠觉醒周期的改变等”（C错）。错觉是对客观事物歪曲的知觉。错觉可见于正常人，如在光线暗淡的环境中看错物体，在恐惧、紧张和期待等心理状态下产生错听等，但正常人的错觉经过验证后可以认识到自己的错误并加以纠正。病理性错觉常在意识障碍时出现，多表现为错视和错听，并常带有恐怖色彩，如患者把输液管看成一条正在吸血的蛇等。多见于谵妄状态（E错）。